关于大脑动脉环的描述，何者是错误的
A. 大脑动脉环环绕视交叉、灰结节和乳头体
B. 颈内动脉可发出大脑前、中动脉
C. 前交通动脉连结两侧大脑前动脉
D. 基底动脉可发出大脑后动脉
E. 大脑中动脉发出后交通动脉与大脑后动脉吻合

正确答案：E。大脑中动脉发出后交通动脉与大脑后动脉吻合

解析：大脑动脉环由两侧大脑前动脉起始段、两侧颈内动脉末段、两侧大脑后动脉借前、后交通动脉共同组成，其中大脑后动脉属于基底动脉的分支（D对）、后交通动脉属于颈内动脉的分支（E错，为本题正确答案）；前交通动脉连结两侧大脑前动脉（C对）。动脉环位于脑底下方，蝶鞍上方，环绕视交叉、灰结节和乳头体（A对）。大脑前、中动脉均属于颈内动脉的分支（B对）。